某女性，纺织女工，年龄35岁。在某纺织厂从事纺纱和织布工作已10年以上。近来主诉耳鸣、听力下降等症状。经检查听阀提高20dB，10～20小时后恢复听力，属何种类型听力损害
A. 听觉适应
B. 噪声性听力损伤
C. 噪声性耳聋
D. 暂时性听力下降
E. 听觉疲劳

正确答案：E。听觉疲劳

解析：本题考查听觉疲劳的症状。听觉疲劳（E对ABCD错）是指较长时间停留在强噪声环境中，引起听力明显下降，听阈提高超过15～30dB，离开噪声环境后，需要数小时甚至数十小时听力才能恢复。该工人的职业史、症状符合听觉疲劳的要求，因此诊断为听觉疲劳。